全蝎研末吞服，成人的每次用量是
A. 0.6～1g
B. 1.5～2g
C. 2.5～3g
D. 3.5～4g
E. 4.5～5g

正确答案：A。0.6～1g

解析：本题考查全蝎的用法用量。全蝎研末吞服，成人的每次用量是0.6～1g（A对）。全蝎【用法用量】内服：煎汤，3～6g；研末，每次0.6～1g；也可入丸散。外用：适量，研末外敷。